久病咳喘，胸闷心悸，乏力少气，自汗声低，舌淡脉弱，其证候是
A. 肺肾气虚
B. 肺气虚
C. 脾肺气虚
D. 心肺气虚
E. 肾气不固

正确答案：D。心肺气虚

解析：肺肾气虚有呼多吸少，耳鸣的症状，无心悸、胸闷的症状（A错）。肺气虚无心悸、胸闷的症状（B错）。脾肺气虚有食少、腹胀、便溏等脾虚的症状，无心悸、胸闷的症状（C错）。咳喘，乏力少气，自汗可知有肺气虚的症状，心悸为心气虚，鼓动无力的症状，胸闷为心气虚，宗气不足，气滞胸中的症状，故辨为心肺气虚证（D对）。肾气不固无心悸、胸闷、咳喘、自汗等症状（E错）。